下列属于选择偏倚的是
A. 诊断怀疑偏倚
B. 暴露怀疑偏倚
C. 入院率偏倚
D. 时间效应偏倚
E. 回忆偏倚

正确答案：C。入院率偏倚